职业流行病学调查主要目的是了解接触与职业性损害的
A. 因果关系
B. 剂量-反应（或效应）关系
C. 剂量-效应关系
D. 时间分布关系
E. 空间分布关系

正确答案：B。剂量-反应（或效应）关系